女，58岁。纳差、上腹部不适3年。胃镜检查示：胃黏膜变薄，皱襞稀疏。血红蛋白86g/L，MCV102fl。该患者应主要补充的维生素是
A. 维生素C
B. 维生素A
C. 维生素E
D. 维生素K
E. 维生素B₁₂

正确答案：E。维生素B₁₂

解析：老年女性患者，既往有纳差、上腹部不适3年病史（慢性胃炎症状）。胃镜检查：胃黏膜变薄，皱襞稀疏（慢性萎缩性胃炎的胃镜表现），Hb86g/L（＜90g/L为中度贫血），MCV102fl（＞100fl为大细胞性贫血），诊断为慢性萎缩性胃炎。慢性萎缩性胃炎分为A型胃炎和B型胃炎，A型胃炎多累及壁细胞，导致内因子分泌减少，VitB₁₂吸收障碍，发生巨幼细胞性贫血，故该患者应主要补充的维生素是维生素B₁₂（E对）。维生素C（九版生物化学P392）（A错）缺乏可引起坏血病；维生素A（九版生物化学P382）（B错）缺乏可引起夜盲症；维生素E（九版生物化学P383）（C错）缺乏可引起轻度贫血；维生素K（九版生物化学P384）（D错）缺乏可引起出血。